可杀灭细菌芽胞，用于外科器械灭菌，使用10%溶液，浸泡60～120分钟，此种化学试剂是
A. 乙醇
B. 碘伏
C. 甲醛
D. 含氯消毒剂
E. 戊二醛

正确答案：C。甲醛

解析：甲醛：本品具有良好的杀菌作用，可杀灭细菌繁殖体与芽孢，以及真菌和病毒等。用于外科器械灭菌，使用10%溶液，浸泡60～120分钟，用时应以灭菌蒸馏水冲净残留药液。掌握“口外消毒和灭菌”知识点。